应激时最核心的神经内分泌反应可能是
A. 肾上腺素的分泌
B. 去甲肾上腺素的分泌
C. CRH的分泌
D. 胰岛素的分泌
E. 胰高血糖素的分泌

正确答案：C。CRH的分泌

解析：CRH的分泌（C对）可能是应激时最核心的神经内分泌反应。